开放性气胸引起的病理生理紊乱表现为
A. 患侧胸膜压力高于大气压，纵隔移向健侧
B. 患侧肺萎缩，呼吸功能减退
C. 吸气时，纵隔移向患侧
D. 呼气时，患侧胸膜压力低于大气压
E. 引起反常呼吸运动，导致呼吸、循环衰竭

正确答案：B。患侧肺萎缩，呼吸功能减退

解析：开放性气胸指外界空气经胸壁伤口或软组织缺损处，随呼吸自由进出胸膜腔。伤口大于气管口径时，胸内压几乎等于大气压（AD错），伤侧肺将完全萎陷，丧失呼吸功能（B对）。呼吸时引起纵隔扑动，吸气时，纵隔移向健侧（C错），呼气时移向伤侧。反常呼吸运动是连枷胸的表现（E错）。开放性气胸患侧胸内压力始终约等于大气压。吸气时，健侧胸内压小于大气压（这样气体才能吸进肺），也就是小于患侧胸内压，纵隔移向健侧；呼气时，健侧胸内压大于大气压（这样气体才能呼出来），由于患侧胸内压力始终约等于大气压，也就是说呼气时健侧胸内压大于，把纵隔推向患侧。